具有补体Clq结合点的Ig是
A. IgE和IgD
B. IgA和IgG
C. IgM和IgA
D. IgG和IgM
E. IgM和IgE

正确答案：D。IgG和IgM